男，54岁。20天内呕血2次，之后大便发黑。乙肝病史30年。贫血貌，浅表淋巴结未触及，皮肤蜘蛛痣和出血点。腹软，肝未触及，腹水征（+）。肾功能正常。胃镜检查见食管静脉曲张。如果治疗后又发生大出血，最易发生的并发症是
A. 肝性脑病
B. 急性左心衰竭
C. 重度腹水
D. 急性肾衰竭
E. 急性肝坏死

正确答案：A。肝性脑病

解析：患者乙肝病史30年，脾肿大，有腹水，诊断为肝炎后肝硬化，门脉高压症。多次呕血，胃镜见食管静脉曲张，诊断为胃底食管曲张静脉破裂出血。门静脉高压症病人反复上消化道出血，将加重肝功能损害，最易诱发肝性脑病（A对）。并发急性左心衰竭（B错）、急性肝坏死（E错）极少见。门脉高压可并发重度腹水（C错）、急性肾衰竭（D错），均较肝性脑病少见。